关于TFⅡD的叙述，下列哪项正确
A. 是唯一能与TATA盒结合的转录因子
B. 能促进RNApolⅡ与启动子结合
C. 具有ATP酶活性
D. 能解开DNA双链
E. 抑制DNA基因转录

正确答案：A。是唯一能与TATA盒结合的转录因子